吗啡用于治疗的适应证为
A. 颅脑外伤疼痛
B. 诊断未明急腹症疼痛
C. 哺乳期妇女止痛
D. 分娩止痛
E. 急性严重创伤、烧伤所致疼痛

正确答案：E。急性严重创伤、烧伤所致疼痛

解析：吗啡具有强大的镇痛作用，对绝大多数急性痛和慢性痛的镇痛效果良好，尤其是严重创伤、烧伤、手术等引起的剧痛（E对）和晚期癌症疼痛。但是颅脑外伤（A错）常导致颅内压增高，是使用吗啡的禁忌症。在疾病未诊断明确前，慎用吗啡（B错），导致掩盖病情而延误诊断。吗啡对抗缩宫素对子宫的兴奋作用而延长产程，且能通过胎盘屏障或经乳汁分泌，抑制新生儿和婴儿呼吸，故禁用于分娩止痛（D错）和哺乳期妇女止痛（C错）。